男，56岁的心房颤动患者，突然发生命名物名困难。二周来共发生过5次，每次持续2～15秒。查体无神经系统异常。脑CT无异常。最适宜的预防治疗是
A. 阿司匹林
B. 华法林
C. 丙戊酸钠
D. 胞二磷胆碱
E. 降纤酶

正确答案：B。华法林

解析：患者初步诊断为短暂性脑缺血发作（TIA）。TIA是急症，发病后2-7天为卒中的高风险期，因此应采取预防措施减少卒中的发生。患者有心房颤动，易形成附壁血栓，血栓脱落可导致脑栓塞，因此伴发房颤的TIA，属于脑卒中高危患者，应使用华法林（B对）进行抗凝治疗，而不是抗血小板治疗（A错）；丙戊酸钠（C错）是一种广谱抗癫痫药；胞二磷胆碱（D错）可改善头部外伤后或脑手术后意识障碍的意识状态及脑电图，促进脑卒中偏瘫病人的上肢运动功能的恢复，对促进大脑功能恢复、促进苏醒有一定作用。降纤酶（E错）通过降低纤维蛋白原起抑制血栓形成和溶解血栓的作用，但不是TIA患者预防血栓形成的首选用药。